红细胞唯一的能量来源是
A. 糖酵解
B. 糖的有氧氧化
C. 磷酸戊糖途径
D. 2'3'-BPG旁路
E. 葡糖醛酸途径

正确答案：A。糖酵解